危险因素影响健康的特点不包括
A. 潜伏期长
B. 特异性弱
C. 联合作用
D. 广泛存在
E. 作用明显

正确答案：E。作用明显